AG正常型代谢型酸中毒常见于
A. 腹泻
B. 幽门梗阻
C. 严重肾功能衰竭
D. 重度高钾血症
E. 严重贫血

正确答案：A。腹泻

解析：AG正常型代谢型酸中毒常见挥发酸增多的代谢型酸中毒，腹泻（A对）可引起NaHC03大量丢失，属于AG正常型代谢型酸中毒。严重肾功能衰竭（C错）、重度高钾血症（D错）、严重贫血（E错）均引起固定酸增多，属于AG增高型代谢性酸中毒。幽门梗阻（B错）后由于胃无法排空而呕吐，会使富含HCl的胃液大量丢失而导致代谢性碱中毒。